下列说法错误的是
A. 角膜神经末梢丰富
B. 脉络膜血管丰富
C. 巩膜不透明
D. 角膜透明而富有血管
E. 虹膜内含平滑肌

正确答案：D。角膜透明而富有血管

解析：角膜无色透明无血管，而非透明而富有血管（D错，为本题正确答案），但神经末梢丰富（A对）。脉络膜血管丰富（B对）。巩膜乳白色不透明（C对）。虹膜内含有的瞳孔括约肌和瞳孔开大肌均为平滑肌（E对）。